微波辐射影响
A. 听觉系统
B. 心血管系统
C. 急慢性疾病和某些癌变
D. 免疫力
E. 血液循环

正确答案：B。心血管系统

解析：本题考查微波辐射对机体的影响。微波辐射是指由电磁波产生的辐射，它可以穿透物体，影响人体的健康。微波辐射可以影响人体的各个系统，其中最常见的影响是心血管系统（B对ACDE错）。心血管系统是人体的重要系统，它负责调节血液循环，维持血液的正常流动，保证人体的健康。微波辐射可以影响心血管系统的正常功能，导致心脏病、高血压等疾病的发生。